多数细菌的代时为
A. 18小时
B. 25分钟
C. 72小时
D. 60分钟
E. 20秒

正确答案：B。25分钟

解析：多数细菌的代时为20～30分钟，而结核分枝杆菌的代时则为18～20小时。掌握“细菌的生理”知识点。